易引起乳酸血症的药物是
A. 格列吡嗪
B. 甲苯磺丁脲
C. 二甲双胍
D. 氯磺丙脲
E. 阿卡波糖

正确答案：C。二甲双胍

解析：乳酸血症是由于双胍类药物促进肌肉组织对葡萄糖的无氧酵解，乳酸产生增加所致，尤以苯乙福明发生率高，故目前已少用（C对）。